完全激动药的特点是
A. 对受体亲和力强，无内在活性
B. 对受体亲和力强，内在活性弱
C. 对受体亲和力强，内在活性强
D. 对受无体亲和力，无内在活性
E. 对受体亲和力弱，内在活性弱

正确答案：C。对受体亲和力强，内在活性强

解析：本题考查作用于受体药物的分类。完全激动药的特点是对受体亲和力强，内在活性强（C对）。完全激动药也称激动剂，有很大的亲和力和内在活性（α=1），能与受体结合并产生最大效应。对受体亲和力强，无内在活性（A错）的是拮抗药。对受体亲和力强，内在活性弱（B错）的是部分激动药。